治疗各种厌氧菌感染的重要药物是
A. 磺胺嘧啶
B. 甲硝唑
C. 甲氧苄啶
D. 诺氟沙星
E. 甲磺灭脓

正确答案：B。甲硝唑

解析：甲硝唑又称灭滴灵，是目前临床治疗各种厌氧菌感染的重要药物之一（B对）。